食物中毒是由于进食了下列哪种食物引起的
A. 有毒食物
B. 腐败变质的食物
C. 正常数量可食状态的有毒食物
D. 动物性食物
E. 植物性食物

正确答案：C。正常数量可食状态的有毒食物